伦理审查委员会伦理审查的任务
A. 心理学研究项目
B. 受试者的知情同意
C. 医学新技术研究项目
D. 受试者的个人隐私
E. 对生物学研究项目进行伦理审查检查和监督

正确答案：E。对生物学研究项目进行伦理审查检查和监督

解析：《涉及人的生物医学研究伦理审查办法（试行）》规定，开展涉及人的生物医学研究项目和相关技术应用活动的机构，包括医疗卫生机构、科研院所、疾病预防控制和妇幼保健机构等，设立机构伦理委员会并对生物学研究项目进行伦理审查检查和监督（E对）。